下列不是建（牙合）的动力平衡中向后的动力来源的是
A. 颊肌
B. 舌肌
C. 唇方肌
D. 颧肌
E. 颏肌

正确答案：B。舌肌

解析：本题考查（牙合）的生长发育。舌肌（B错，为本题正确答案）不是建（牙合）的动力平衡中向后的动力来源，舌肌是向前的动力的来源。建（牙合）的动力平衡中向后的动力：主要来自唇和颊肌，如口轮匝肌、上、下唇方肌、尖牙肌、颧肌、颊肌及颏肌等。向后的力主要加在上、下颌前牙，通过邻面接触点而传至整个牙弓，又通过牙尖斜面在上、下牙之间相互传递。